睾丸是位于阴囊内左、右成对的扁卵圆形实质性器官，是男性生殖腺，可产生精子和男性激素。精子产生于
A. 附睾管
B. 精囊
C. 直精小管
D. 生精小管
E. 睾丸输出小管

正确答案：D。生精小管

解析：生精小管（D对）的生精上皮产生精子。